短时间接触噪声，听阈提高10～15dB，并可立即恢复听力，属何种类型听力损伤
A. 听觉适应
B. 暴震性耳聋
C. 听觉疲劳
D. 噪声性耳聋
E. 噪声性听力损伤

正确答案：A。听觉适应

解析：本题考查听觉适应的症状。听觉适应（A对BCDE错）是指短时间暴露在强烈噪声环境中，机体听觉器官敏感性下降，听阈提高10～15dB，脱离噪声接触后对外界的声音有“小”或“远”的感觉，离开噪声环境1分钟之内即可恢复的现象。